麻黄生物碱主要集中在麻黄的
A. 根
B. 根皮
C. 叶
D. 茎
E. 茎的髓部

正确答案：E。茎的髓部

解析：本题考查的是生物碱的分布部位。麻黄生物碱主要集中在麻黄的茎的髓部（E对）。生物碱在植物体内多数集中分布于某一器官或某一部位，如金鸡纳生物碱主要分布在金鸡纳树皮中；麻黄生物碱在麻黄髓部含量高；黄柏生物碱主要集中在黄柏树皮中；三颗针生物碱主要集中在根部（A错），尤以根皮中含量最高（B错）。